男性，56岁，急性广泛前壁心肌梗死，入院后6小时，首选下列哪项治疗措施
A. 口服美多洛尔
B. 链激酶溶栓治疗
C. 静脉注射西地兰
D. 口服巯甲丙脯酸
E. 口服卡托普利

正确答案：B。链激酶溶栓治疗

解析：患者因急性心肌梗死入院6小时，治疗原则是尽快回复患者心肌血液灌注（住院后开始溶栓治疗）以挽救频死的心肌、防止梗死扩大或缩小心肌缺血范围，保护和维持心脏功能，及时处理严重心律失常、泵衰竭和各种并发症，防止猝死，使患者不但能够度过急性期，且康复后还能保持尽可能多的有功能的心肌。故此患者应该首选溶栓治疗。掌握“冠状动脉粥样硬化性心脏病”知识点。